某市要兴建一较大工厂，为确定该工厂位置，观测其常年主导风向为西北风。那该工厂应设在该城市的
A. 西北方
B. 东南方
C. 西南方
D. 东北方
E. 东方

正确答案：B。东南方

解析：本题考查工业用地的选择。工业用地应按当地主导风向配置在生活居住用地的下风侧，由于该地常年主导风向为西北风，因此该工厂应设在该城市的东南方（B对ACDE错）。